门静脉高压时，肝门静脉血液返流入上、下腔静脉系时，不通过
A. 食管静脉丛
B. 翼静脉丛
C. 脐周静脉网
D. 椎静脉丛
E. 直肠静脉丛

正确答案：B。翼静脉丛

解析：门静脉高压时，肝门静脉血液返流入上、下腔静脉系时，通过食管静脉丛（A对）、脐周静脉网（C对）、椎静脉丛（D对）、直肠静脉丛（E对）等交通途径。翼静脉丛（B错，为本题正确答案）为面静脉与海绵窦之间的交通途径。